医师中止执业活动二年以上，当其中止的情形消失后，需要恢复执业活动的，应当经所在地的县级以上卫生行政部门委托的机构或者组织考核合格，并依法申请办理
A. 准予注册手续
B. 中止注册手续
C. 注销注册手续
D. 变更注册手续
E. 重新注册手续

正确答案：E。重新注册手续

解析：《执业医师法》规定，中止医师执业活动2年以上以及不予注册的情形消失的，申请重新执业，应当依法重新注册（E对）。《医师执业注册暂行办法》规定，重新申请注册的人员，应当首先到县级以上卫生行政部门指定的医疗、预防、保健机构或组织，接受3至6个月的培训，并经考核合格，方可依照有关规定重新申请执业注册。